异烟肼与维生素B₆合用，可减少
A. 神经系统毒性
B. 中枢兴奋作用
C. 降压作用
D. 低血钾
E. 骨髓抑制

正确答案：A。神经系统毒性

解析：本题考查药物的相互作用。异烟肼与维生素B₆合用，可减少神经系统毒性（A对）。异烟肼为维生素B₆的拮抗剂，可增加维生素B₆经肾排出量，因而可能导致周围神经炎，因此与异烟肼合用时维生素B₆的需要量增加。